听觉传导通路
A. 由三级神经元构成
B. 感受器为椭圆囊斑和球囊斑
C. 第一级神经元位于前庭神经节
D. 纤维交叉形成内侧丘系
E. 交叉处纤维形成斜方体

正确答案：E。交叉处纤维形成斜方体

解析：听觉传导通路由二级神经元构成（A错），其感受器为内耳的螺旋器（或称 Corti 器）（B错），听觉传导通路的第1级神经元为蜗神经节内的双极神经细胞（C错），纤维交叉形成外侧丘系（D错），交叉处纤维形成斜方体（E对）。